丙种球蛋白用于小儿被动免疫，主要用于预防
A. 流感
B. 麻疹
C. 百日咳
D. 结核病
E. 乙型脑炎

正确答案：B。麻疹

解析：丙种球蛋白用于小儿被动免疫，主要用于预防麻疹（B对）。